男患者，50岁。突发头痛，呕吐，体温40度，伴躁动，2日后频繁癫痫发作，昏迷，3日后死亡，病理检查脑实质内出血性坏死，细胞核内包涵体，该病为
A. 腺病毒性脑炎
B. 巨细胞病毒性脑炎
C. 急性播散性脑脊髓炎
D. 带状疱疹病毒性脑炎
E. 单纯疱疹病毒性脑炎

正确答案：E。单纯疱疹病毒性脑炎

解析：患者老年男性，突发头痛，呕吐，体温40度，伴躁动，2日后频繁癫痫发作，昏迷，3日后死亡，病理检查脑实质内出血性坏死，细胞核内包涵体。根据病史特点，应诊断为单纯疱疹病毒性脑炎（E对）。腺病毒性脑炎（A错）一般经呼吸系统感染，常有肺部感染病史且肺部体征明显。巨细胞病毒性脑炎（B错）主要见于艾滋病等免疫缺陷或长期使用免疫抑制剂的患者，病程较慢。急性播散性脑脊髓炎（C错）多在感染或疫苗接种后急性发病，癫痫发作少见，还会出现脊髓受损的症状和体征（P237）。带状疱疹病毒性脑炎（D错）患者多有胸腰部带状疱疹的病史，会有精神异常及局灶性神经功能缺失体征，头颅CT无出血性坏死的表现，且病变程度相对较轻，预后较好（P237）。